七情配伍中，可以降低药物功效的是
A. 相须
B. 相使
C. 相畏
D. 相杀
E. 相恶

正确答案：E。相恶

解析：相恶即两种药物合用，一种药物与另一药物相作用而致原有功效降低，甚至丧失药效（E对）。相须（A错），即性能功效相类似的药物配合应用，可以增强其原有疗效。相使（B错），即将性能功效方面有某些共性的药物配合应用，以一种药物为主，另一种药物为辅，辅药能提高主药的疗效。相畏（C错）就是一种药物的毒性或副作用能被另一种药物降低或消除。相杀（D错）指一种药物能够降低或消除另一种药物的毒性或副作用。